高镁血症
A. 心肌兴奋性升高，心肌传导性下降，心肌自律性升高，心肌收缩性升高
B. 心肌兴奋性下降，心肌传导性下降，心肌自律性下降，心肌收缩性下降
C. 心肌兴奋性下降，心肌传导性升高，心肌自律性下降，心肌收缩性下降
D. 心肌兴奋性升高，心肌传导性升高，心肌自律性升高，心肌收缩性下降
E. 心肌兴奋性下降，心肌传导性下降，心肌自律性下降，心肌收缩性升高

正确答案：B。心肌兴奋性下降，心肌传导性下降，心肌自律性下降，心肌收缩性下降

解析：细胞外液镁浓度升高时，心肌细胞Em绝对值变大，去极化时Na⁺内流速度加快，心肌兴奋性下降（AD错）。高镁血症时，Mg2＋对心肌快反应自律细胞的缓慢而恒定的钠内流的阻断作用增强，导致钠内流相对减速，自动去极化减慢，自律性下降。高镁血症使Na⁺-K⁺-ATP酶活性增高，心肌细胞内钾增多，心肌细胞收缩性下降（B对E错）。